抗结核化学药物治疗的目的有
A. 使痰菌迅速转阴
B. 减少结核病传播
C. 防止耐药菌株产生
D. 达到部分治愈
E. 达到完全治愈

正确答案：A、B、C、E。使痰菌迅速转阴；减少结核病传播；防止耐药菌株产生；达到完全治愈

解析：本题考查抗结核化学药物治疗。抗结核化学药物治疗的目的在于缩短传染期、降低死亡率、感染率及患病率。对每个具体患者，则为达到临床及生物学治愈的主要措施。其目标是：①在最短的时间内使痰菌转阴（A对），减少结核病的传播（B对）；②防止耐药菌株的产生（C对）；③达到完全治愈（E对D错），避免结核复发。